动作电位是可兴奋细胞兴奋的标志。动作电位的大小
A. 不随细胞种类而异
B. 具有全或无性质
C. 随刺激强度增加而改变
D. 相当于K⁺平衡电位
E. 随传导距离而改变

正确答案：B。具有全或无性质